典型霍乱患者，发病后最先出现的常见症状是
A. 畏寒、发热
B. 声嘶
C. 剧烈腹泻，继之呕吐
D. 腹部绞痛
E. 腓肠肌痉挛

正确答案：C。剧烈腹泻，继之呕吐